常见的三萜皂苷类型有
A. 羊毛甾烷型
B. 螺旋甾烷型
C. 乌苏烷型
D. 齐墩果烷型
E. 羽扇豆烷型

正确答案：A、C、D、E。羊毛甾烷型；乌苏烷型；齐墩果烷型；羽扇豆烷型

解析：本题考查的是三萜皂苷的分类。常见的三萜皂苷类型有羊毛甾烷型（A对）、乌苏烷型（C对）、齐墩果烷型（D对）与羽扇豆烷型（E对）。三萜皂苷是由三萜皂苷元和糖组成，苷元为三萜类化合物，其基本骨架由6个异戊二烯单位组成。三萜的种类很多，但以皂苷形式存在的三萜类型并不多，较为常见的有羊毛甾烷型、达玛烷型、齐墩果烷型、乌苏烷型和羽扇豆烷型，其中前两种属于四环三萜，后三种则属于五环三萜。螺旋甾烷型（B错）属于甾体皂苷。甾体皂苷与三萜皂苷相似，均由甾体皂苷元与糖组成，这是天然广泛存在的一类化学成分。甾体皂苷分类主要有螺旋甾烷醇类、异螺旋甾烷醇类、呋甾烷醇类和变形螺旋甾烷醇类。